下列关丁治疗骨质疏松症的药物说法中，错误的是
A. 双膦酸盐类属于抑制骨吸收的药物
B. 生长激素属于促进骨形成的药物
C. 替勃龙属于促进骨形成的药物
D. 雷洛昔芬属于抑制骨吸收的药物
E. 降钙素属于抑制骨吸收的药物

正确答案：C。替勃龙属于促进骨形成的药物

解析：本题考查抗骨质疏松药的分类。替勃龙属于抑制骨吸收药（C错，为本题正确答案）。